麦门冬汤组成中麦门冬与半夏的比例是
A. 9:1
B. 7:1
C. 5:1
D. 3:1
E. 1：1

正确答案：B。7:1

解析：麦门冬汤中麦门冬七升、半夏一升，麦门冬和半夏的用量比例为7:1（B对）。九一丹中石膏九钱，黄灵药一钱，石膏和黄灵药的比为9：1（A错）。当归补血汤中黄芪一两、当归二钱，黄芪和当归的比为5：1（C错）。旋覆代赭汤中旋复花三两、代赭石一两，旋复花和代赭石用量比例为3:1（D错）。桂枝汤桂枝三两，芍药三两，桂枝和芍药的用量比是1:1（E错）。